适合于制成注射用无菌粉末的药物是
A. 水中难溶且稳定的药物
B. 水中易溶且稳定的药物
C. 油中易溶且稳定的药物
D. 水中易溶且不稳定的药物
E. 油中不溶且不稳定的药物

正确答案：D。水中易溶且不稳定的药物

解析：本题考查注射用无菌粉末。在水溶液中不稳定的药物（D对），特别是一些对湿热十分敏感的抗生素类药物及血浆等生物制品，如青霉素G的钾盐和钠盐、头孢菌素类及一些酶制剂（胰蛋白酶、辅酶A等），用一般药剂学稳定化技术尚难得到满意的注射剂产品时，可制成固体形态的注射剂。水中难溶且稳定的药物（A错）宜制成混悬型注射剂。水中易溶且稳定的药物（B错）宜制成溶液型注射剂。油中易溶且稳定的药物（C错）宜制成油型注射剂。油中不溶且不稳定（E错）的药物宜制成乳剂型注射剂。